与妊娠期龈炎的发生关系最密切的因素是
A. 年龄
B. 遗传因素
C. 吸烟史
D. 体内性激素的变化
E. 精神压力

正确答案：D。体内性激素的变化

解析：本题考查妊娠期龈炎的病因。与妊娠期龈炎的发生关系最密切的因素是体内性激素的变化（D对）。妊娠可导致性激素水平发生改变，牙龈毛细血管扩张充血，血管通透性增加，炎症细胞和体液渗出增加，加重牙菌斑引起的炎症反应。由年龄引起的性激素水平变化是牙龈炎的全身因素之一（A错）。牙周炎的全身促进因素为遗传因素（B错）、性激素、吸烟（C错）、有关系统疾病、精神压力（E错）。